腭前神经出自
A. 腭前孔
B. 腭大孔
C. 腭小孔
D. 蝶腭孔
E. 眶下孔

正确答案：B。腭大孔

解析：本题考查腭前神经。腭前神经又名腭大神经，出自腭大孔（B对）向前行于上颌骨腭突的附近，分布于上颌后牙及尖牙的腭侧黏骨膜及牙龈，并在上颌尖牙的腭侧黏骨膜内与鼻腭神经吻合。腭前孔（切牙孔）有鼻腭神经穿出（A错）。腭小孔有腭中、后神经穿出（C错）。蝶腭孔有翼腭神经的鼻支通过（D错）。眶下孔有眶下神经通过（E错）。